治疗胸胁停饮，风痰癫痫，应选用的善泻胸胁之水的药物是
A. 芒硝
B. 大黄
C. 甘遂
D. 牵牛子
E. 巴豆

正确答案：C。甘遂

解析：甘遂的功效为泻水逐饮，消肿散结。治疗水肿胀满，胸腹积水，痰饮积聚，气逆咳喘，二便不利；风痰癫痫；痈肿疮毒（C对）。大黄的功效为泻下攻积，清热泻火，凉血解毒，止血，逐瘀通经，利湿退黄。治疗实热积滞便秘；血热吐衄，目赤咽肿，牙龈肿痛；痈肿疔疮，肠痈腹痛；瘀血经闭，产后瘀阻，跌打损伤；湿热痢疾，黄疸尿赤，淋证，水肿；烧烫伤（A错）。巴豆霜的功效为峻下冷积，逐水退肿，豁痰利咽；外用蚀疮。治疗寒积便秘；小儿乳食停积；腹水鼓胀，二便不通；喉风，喉痹；痈肿脓成未溃，疥癣恶疮，疣痣（C对）。火麻仁的功效为润肠通便。治疗血虚津亏，肠燥便秘（B错）。牵牛子的功效为泻水通便，消痰涤饮，杀虫攻积。治疗水肿胀满，二便不通；痰饮积聚，气逆喘咳；虫积腹痛（E错）。